患者寒战、高热，咳嗽、咯痰，胸痛，气急。查体：气管位置居中，左胸呼吸动度减弱，左中肺语颤增强，叩诊呈浊音，听诊可闻及湿啰音及支气管肺泡呼吸音。应首先考虑的是
A. 肺脓肿
B. 胸膜炎
C. 肺不张
D. 肺炎
E. 肺结核

正确答案：D。肺炎

解析：患者寒战、高热，咳嗽、咯痰，胸痛，气急。查体发现气管位置居中，左胸呼吸动度减弱，左中肺语颤增强，叩诊呈浊音，听诊可闻及湿啰音及支气管肺泡呼吸音，符合肺炎（D对）的诊断标准。肺脓肿（A错）的特点为咳大量腥臭脓痰。胸膜炎（B错）主要表现为胸痛，呼吸困难。肺不张（C错）气管位置不会居中。肺结核（E错）的特点为低热，乏力，盗汗，咳嗽，咳血，消瘦。